健康相关生命质量的主要内容
A. 客观体验和主观体验
B. 健康状态和主观体验
C. 生物-心理-社会医学模式的具体表现
D. 健康状态和生命质量
E. 疾病的体验和老化的体验

正确答案：B。健康状态和主观体验

解析：本题考查健康相关生命质量的主要内容。健康相关生命质量的主要内容包括生理状态、心理状态、社会功能状态、主观判断与满意度（B对ACDE错）。